研究表明，具有C型人格特征的人易患
A. 冠心病
B. 糖尿病
C. 恶性肿瘤
D. 哮喘
E. 偏头痛

正确答案：C。恶性肿瘤